水源水监测采用的必测项目有
A. pH
B. 总有机碳
C. 致病菌
D. 溶解氧
E. 碘

正确答案：A。pH

解析：本题考查水源水监测的必测项目。水源水监测是指对水源水质进行监测，以确保水源水质符合国家规定的标准。水源水监测采用的必测项目包括：pH（A对BCDE错）、水温、色度、浑浊度、臭和味、总硬度、铁、锰、砷、氟化物、氯化物、硫酸盐、氨氮、亚硝酸盐氮、硝酸盐氮、耗氧量、总大肠菌群和细菌总数、耐热大肠菌群、游离氯。